能“司二便”的脏腑是
A. 脾
B. 肾
C. 三焦
D. 膀胱
E. 大肠

正确答案：B。肾

解析：本题考查的是肾与窍的关系。能“司二便”的脏腑是肾（B对）。肾在窍为耳及二阴：（1）肾在窍为耳，说明了耳的听觉功能灵敏与否，与肾中精气的盈亏有密切关系。肾中精气充盈，髓海得养，则听觉灵敏。人到老年，肾中精气逐渐衰减，髓海空虚，每多见耳鸣、耳聋。（2）二阴，即前阴和后阴。前阴指外生殖器和尿道，后阴指肛门。前阴与排尿和生殖功能有关，后阴与排便功能有关。二便的排泄，有赖于肾的气化才能完成，故“肾开窍于二阴”“肾主二便”。肾主生殖，外生殖器的功能也直接与肾气强弱相关。脾（A错）在窍为口，其华在唇：（1）口，指口腔，是消化管的起端，食物由此下咽以至食道，具有咀嚼、初步消化，并参与吞咽等功能。脾开窍于口，说明脾运强健，则口味正常，食欲良好；脾失健运，则不仅可见食欲不振，还可见到口味异常，如口淡、口腻、口甜、口臭等。（2）唇，口唇。脾主运化，为气血生化之源，脾的运化功能强健与否，可反映于口唇。如脾运强健，口唇见色泽红润；脾运失健，口唇见萎黄不泽。三焦（C错）：三焦是上焦、中焦、下焦的合称。因在人体脏腑中，唯其最大，又无脏与之相表里，故三焦又有“孤府”之称。三焦总的生理功能为主持诸气，总司人体的气机和气化，为元气运行的通路和水液运行的通道。膀胱（D错）：膀胱位于小腹中央。膀胱的主要生理功能是贮尿和排尿。膀胱和肾直接相通，二者又有经脉相互络属，故膀胱与肾相为表里。津液在代谢过程中，经过肾的蒸腾气化作用，清者经脾达肺，重新参与津液代谢；浊者生成尿液。膀胱可贮留一定最的尿液，开合有度，尿液可及时地从溺窍排出体外。膀胱的开合有度依赖于肾气的推动和固摄作用调节。大肠（E错）：大肠居于下腹中，其上口在阑门处与小肠相接，其下端紧接肛门（又称魄门）。大肠的主要生理功能是传化糟粕，并吸收部分水液。大肠与肺有经脉相互络属，故相为表里。大肠接受经过小肠泌别清浊后传输而来的食物残渣，吸收其中多余的水液，形成粪便，经肛门而排出体外，故称“大肠主津”。